下颌后静脉
A. 由上颌静脉与枕静脉合成
B. 由颞浅静脉与面静脉合成
C. 椎静脉注入其内
D. 有属支也有分支
E. 汇入锁骨下静脉

正确答案：D。有属支也有分支

解析：下颌后静脉由颞浅静脉和上颌静脉（AB错）汇合而成。上颌静脉起自翼静脉丛。右分为前、后两支，收集面侧区和颞区的静脉血，有属支也有分支（D对）。前支注入面静脉，后支汇入颈外静脉（E错）。